癌症病人亲属或监护人代办“麻醉药品专用卡”不必提供的材料是
A. 二级以上（含二级）医疗机构的诊断证明书
B. 患者本人居住地公安机关发放的本人户口簿
C. 主治医师以上专业技术职称的医师开写的麻醉药品处方
D. 患者本人的身份证
E. 代办人的身份证

正确答案：C。主治医师以上专业技术职称的医师开写的麻醉药品处方